对寻常痤疮的临床表现叙述正确的有
A. 好发于前额、颜面、胸背上部和肩胛部
B. 初期为散在性红斑或水疱，水疱壁透明
C. 多为散在与毛囊一致的黑色丘疹，挤压后可有黄白色脂性栓排出
D. 炎症较重时，可长久存在，亦可逐渐吸收或溃疡形成窦道
E. 分泌物干后形成蜜黄色或污黄色痂，愈后无瘢痕

正确答案：A、C、D。好发于前额、颜面、胸背上部和肩胛部；多为散在与毛囊一致的黑色丘疹，挤压后可有黄白色脂性栓排出；炎症较重时，可长久存在，亦可逐渐吸收或溃疡形成窦道